天南星除了燥湿化痰外，还可
A. 消食化滞
B. 理气调中
C. 降逆止呕
D. 发表散寒
E. 祛风止痉

正确答案：E。祛风止痉

解析：本题考查的是天南星的功效。天南星除了燥湿化痰外，还可祛风止痉（E对）。天南星：【功效】燥湿化痰，祛风止痉，散结消肿。小儿化食丸：【功能】消食化滞（A错），泻火通便。陈皮：【功效】理气调中（B错），燥湿化痰。半夏：【功效】燥湿化痰，降逆止呕（C错），消痞散结。紫苏：【功效】发表散寒（D错），行气宽中，安胎，解鱼蟹毒。